不是描述性流行病学特征
A. 属观察性研究
B. 不需设立对照组
C. 不能分析因果联系
D. 必须设立对照组

正确答案：D。必须设立对照组

解析：本题考查描述性研究的特征。描述性研究是观察性研究（A对），其特点为：①描述性研究以观察为主要研究手段，不对研究对象采取任何干预措施；②描述性研究中，其暴露因素的分配不是随机的，且在研究开始时一般不设立对照组（B对）（D错，为本题正确答案）；③暴露与结局的时序关系无法确定，对于暴露与结局间关系的因果推断存在一定的局限性（C对）。